固定桥的固位作用主要是靠
A. 黏着剂的黏着力
B. 固位体固位形的正确设计
C. 材料的质量
D. 咬合的平衡
E. 基牙的稳固

正确答案：B。固位体固位形的正确设计

解析：固定桥的固位作用主要是靠固位体固位形的正确设计，基牙的固位作用：足够的牙体组织可以增加牙体与固位体的接触面积；适宜的形态可以增加固位力；健康的组织结构为固位体提供了坚实的基础；龋坏的牙齿，经过治疗可以选作基牙；基牙最好是具有正常代谢功能和反应能力的活髓牙；严重磨耗的牙齿。有良好的固位形和抗力形能够抵抗各种外力而不至于松动，脱落或破损。掌握“固定桥的设计”知识点。